以下不属于破伤风梭菌形态生物学特性的是
A. 革兰氏染色阳性
B. 芽胞位于菌体中央
C. 有周鞭毛，无荚膜
D. 芽胞的抵抗力强
E. 对热、干燥和消毒剂均耐受

正确答案：B。芽胞位于菌体中央

解析：革兰氏染色阳性，有周鞭毛，无荚膜。细菌芽胞位于菌体一端，圆形，较菌体粗，使芽胞菌呈鼓槌状。常用庖肉培养基进行厌氧培养。在血琼脂平板上形成羽毛样菌落，菌落周边有轻度β-溶血。该细菌繁殖体抵抗力与一般细菌相似，其芽胞的抵抗力强，对热、干燥和消毒剂均耐受。掌握“厌氧芽胞梭菌”知识点。